盐酸普鲁卡因注射液检查的杂质是
A. 对氨基苯甲酸
B. 游离水杨酸
C. 莨菪碱
D. 对氨基酚
E. 5-羟甲基糖醛

正确答案：A。对氨基苯甲酸

解析：本题考查普鲁卡因杂质的检查。盐酸普鲁卡因中的特殊杂质为对氨基苯甲酸（A对）。